含有较多味蕾的舌乳头是
A. 丝状乳头
B. 菌状乳头
C. 轮廓乳头
D. 叶状乳头

正确答案：C。轮廓乳头

解析：本题考查味蕾。含有较多味蕾的舌乳头是轮廓乳头（C对）。味蕾主要分布于舌的菌状乳头、轮廓乳头和叶状乳头内。此外，软腭、咽和会厌等处的黏膜上皮内也有味蕾分布。人类口腔有味蕾约4000个，每个菌状乳头味蕾群、叶状乳头味蕾群、轮廓乳头味蕾群分别含有3个、30个、250个左右的味蕾。儿童的味蕾较成人分布广，随着年龄的增长（如50岁左右），味蕾因萎缩而变性，数量减少，导致味觉功能下降。综上所述，含有较多味蕾的舌乳头是轮廓乳头。